下列不属于口腔癌的流行特征的是
A. 地区分布
B. 时间分布
C. 年龄分布
D. 文化分布
E. 种族差异

正确答案：D。文化分布

解析：口腔癌的流行特征包括以下几点：地区分布、时间分布、年龄分布、性别分布、种族差异。掌握“口腔癌的预防”知识点。